口腔念珠菌病按其发病部位的变化分为
A. 念珠菌口炎、念珠菌唇炎、义齿性口炎、慢性黏膜皮肤念珠菌病
B. 正中菱形舌炎、念珠菌性唇炎、义齿性口炎、多灶性念珠菌病、口角炎
C. 念珠菌口炎、念珠菌唇炎、念珠菌口角炎、雪口病
D. 增殖型念珠菌口炎、念珠菌唇炎、念珠菌口角炎、慢性黏膜皮肤念珠菌病
E. 念珠菌口炎、念珠菌唇炎、抗生素口炎、慢性黏膜皮肤念珠菌病

正确答案：B。正中菱形舌炎、念珠菌性唇炎、义齿性口炎、多灶性念珠菌病、口角炎

解析：根据发病部位的变化分为正中菱形舌炎、义齿性口炎、多灶性念珠菌病、口角炎和念珠菌性唇炎。